咪达唑仑过量中毒的特异性解救药物是
A. 氟马西尼
B. 亚甲蓝
C. 乙酰半胱氨酸
D. 青霉胺
E. 纳洛酮

正确答案：A。氟马西尼

解析：本题考查特殊解毒剂。氟马西尼（A对）可用于苯二氮䓬类药物过量或中毒。咪达唑仑属于苯二氮䓬类药物。